支气管扩张的典型痰液表现为
A. 大量白色泡沫状痰
B. 大量脓性痰，有分层
C. 大量粉红色泡沫痰
D. 大量乳状痰
E. 大量白色黏液样痰

正确答案：B。大量脓性痰，有分层

解析：支气管扩张典型症状为慢性咳嗽，咳大量脓性痰和反复咯血，咳出脓性痰液一般分四层（B对），上层为泡沫，下悬脓液成分，中为浑浊黏液，底层为坏死组织沉淀物。大量白色泡沫状痰（A错）一般见于左心衰也可见于慢性支气管炎和慢性阻塞性肺疾病。大量粉红色泡沫痰（C错）常出现于急性左心衰。大量乳状痰（D错）一般见于金黄色葡萄球菌肺炎（金黄色葡萄球菌肺炎痰液也被认为是红色乳状痰）。大量白色黏液样痰（E错）常见于慢性支气管炎和慢性阻塞性肺疾病以及肺泡细胞癌。